流行病学调查方法中的筛检，其目的是
A. 筛选可疑危险因素
B. 探索病因
C. 描述疾病三间分布
D. 早期发现可疑患者
E. 确诊病人

正确答案：D。早期发现可疑患者

解析：本题考查筛检的目的。筛检可发现隐匿的病例，在表面健康的人群中通过筛检选出可能患有某病的个体（D对ABCE错），并进一步进行确诊和早期治疗。